替代学习疗法属于
A. 询者中心疗法
B. 精神分析疗法
C. 行为疗法
D. 认知疗法
E. 生物反馈疗法

正确答案：C。行为疗法